关于连续毛细血管的描述，正确的是
A. 内皮不含核处极薄，基膜不完整
B. 管腔大而不规则
C. 内皮缺乏紧密连接
D. 通透性大，腔内常含有巨噬细胞
E. 内皮连续且有紧密连接，胞浆含有吞饮小泡，基膜完整

正确答案：E。内皮连续且有紧密连接，胞浆含有吞饮小泡，基膜完整

解析：脑和脊髓内的连续毛细血管，有完整（A错）而连续的毛细血管基膜。内皮细胞之间有紧密连接（C错）封闭。内皮连续且有紧密连接，胞浆含有吞饮小泡，基膜完整（E对）。